连续久服地西泮突然停药出现的焦虑激动震颤等症状称之为
A. 耐受性
B. 成瘾性
C. 反跳现象
D. 戒断症状
E. 急性中毒

正确答案：D。戒断症状

解析：一旦中断用药，即可出现强烈的戒断症状，如剧烈疼痛、严重失眠等，并变得身不由己，甚至为获取这些药物而不顾一切，走向严重犯罪。苯二氮䓬类药物长期使用可产生耐受性，也会导致依赖和成瘾，突然停药可出现失眠、头晕、焦虑和震颤等（D对）。